O/W型基质软膏用于分泌物较多的皮肤病时，软膏所吸收的分泌物重新进入皮肤，使炎症恶化的现象是
A. 肠肝循环
B. 反向吸收
C. 清除率
D. 膜动转运
E. 平均滞留时间

正确答案：B。反向吸收

解析：本题考查软膏的应用。反向吸收（B对）指O/W型基质软膏用于分泌物较多的皮肤病时，软膏所吸收的分泌物重新进入皮肤，使炎症恶化。